妊娠八九个月时，或腹中痛，痛定仍然如常者，称之
A. 试胎
B. 弄胎
C. 垢胎
D. 盛胎
E. 滑胎

正确答案：A。试胎

解析：临产时的特征 妊娠八九个月时，或腹中痛，痛定仍然如常者，此名试胎（A对）。若月数已足，腹痛或作或止，腰不痛者，此名弄胎（B错）。受孕初期仍能按月经周期有少量出血而无损于胎儿者，称为盛胎或垢胎（CD错）。凡堕胎或小产连续发生3次或3次以上者，称为滑胎（E错）。